在气的生成过程中，生气之源有赖于
A. 肺的呼吸功能
B. 脾胃运化功能
C. 肾的闭藏功能
D. 肺肾协调功能
E. 心的主血功能

正确答案：B。脾胃运化功能

解析：脾胃运化共同完成对饮食物的消化吸收，脾气上升，将水谷精微上输心肺，化生血与津液，水谷精微及其化生的血与津液，皆可化气，布散全身，是人体之气的主要来源（B对）。肺的呼吸功能（A错）保证了体内之气的生成和代谢，肺主气，司呼吸，将自然界的清气吸入体内，呼出浊气，又将吸入的清气与脾气上输的水谷精微所化生的水谷之气结合，生成宗气。肾藏先天之精，为生气之根（C错）。